必需脂肪酸的特点不包括
A. 是磷脂的重要组成成分
B. 是合成烟酸的前体物质
C. 是合成前列腺素的前体物质
D. 与胆固醇的代谢有关
E. 缺乏可引起生长迟缓、皮肤损伤

正确答案：B。是合成烟酸的前体物质